男性，20岁。反复咳嗽、咳痰量多2年。今天突然咳鲜血300ml，无发热、消瘦。听诊：右下肺闻及小水泡音。应首先考虑的是
A. 大叶性肺炎
B. 肺结核
C. 支气管扩张
D. 风湿性心脏病伴二尖瓣狭窄
E. 肺脓肿

正确答案：C。支气管扩张

解析：患者青年男性，持续反复咳嗽、咯痰量多，突发咯血300ml（支气管扩张的典型症状），无发热、消瘦，右下肺闻及小水泡音（气管内分泌物增多引起），应首先考虑的是支气管扩张（C对）。大叶性肺炎（P46）（A错）起病急骤，主要表现为寒战、高热、胸痛，痰量较少，带血丝或呈铁锈色，查体有肺实变体征。肺结核（P64）（B错）的咳嗽较轻，多呈干咳或少量粘液痰，常有午后潮热、消瘦、乏力、盗汗等症状。风湿性心脏病伴二尖瓣狭窄（P299）（D错）有咯血症状，但咳嗽通常在夜间睡眠或劳动后出现，为干咳或泡沫痰，常伴呼吸困难，查体见左心房扩大，能闻及舒张期杂音。肺脓肿（P58-P59）（E错）主要表现为发热、咳嗽伴大量脓臭痰，慢性患者多有贫血、消瘦、杵状指等表现。